阿片受体的部分激动药是
A. 吲哚美辛
B. 塞来昔布
C. 哌替啶
D. 纳洛酮
E. 喷它佐辛

正确答案：E。喷它佐辛

解析：本题考查μ受体的激动药。喷它佐辛（E对）为阿片受体部分激动剂；哌替啶（C错）为阿片类受体完全激动剂；纳洛酮（D错）为阿片类受体拮抗药；吲哚美辛（A错）、塞来昔布（B错）为芳酸类非甾体抗炎药。